男，56岁的心房颤动患者，突然发生命名物名困难。二周来共发生过5次，每次持续2～15秒。查体无神经系统异常。脑CT无异常。可能的诊断是
A. 脑动脉瘤
B. 脑血栓形成
C. 脑出血
D. 脑血管畸形
E. 短暂性脑缺血发作

正确答案：E。短暂性脑缺血发作

解析：患者老年男性，突然发生命名物名困难，二周来共发生5次（发作频率密集），每次持续2-15秒（发作时间短暂），有心房颤动病史（可致血流动力学紊乱及血栓形成）查体无神经系统异常，脑CT无异常，考虑短暂性脑缺血发作（E对）。短暂性脑缺血发作（TIA）血流动力型临床症状比较刻板，发作频率通常密集，每次发作持续时间一般不超过10分钟，不留后遗症。脑动脉瘤（A错）、脑血管畸形（D错）、脑血栓形成（B错）、脑出血（C错）一般均会有神经系统及（或）CT的异常表现。